能全部通过二号筛，但混有能通过四号筛不超过40%的粉末是
A. 最粗粉
B. 粗粉
C. 细粉
D. 最细粉
E. 极细粉

正确答案：B。粗粉